经营者提供的服务，按国家规定，承担保修、包换、包退责任的应
A. 保证其与提供的商品的实际质量状况相符
B. 向消费者出具服务单据
C. 按约定履行，不得无理拒绝
D. 作出明确的答复
E. 立即向有关行政部门报告和告知消费者

正确答案：C。按约定履行，不得无理拒绝

解析：本题考查消费者权益。经营者提供的服务，按国家规定，承担保修、包换、包退责任的应按约定履行，不得无理拒绝（C对）。《中华人民共和国消费者权益保护法》规定经营者提供的商品或者服务不符合质量要求的，消费者可以依照国家规定、当事人约定退货，或者要求经营者履行更换、修理等义务。